稳定潜在型克山病人，对诊断有意义的心电图改变是
A. T波低平
B. S-T段压低
C. Q-T间期延长
D. 室性期前收缩和右束支传导阻滞
E. S-T段抬高

正确答案：D。室性期前收缩和右束支传导阻滞

解析：本题考查对稳定潜在型克山病人诊断有意义的心电图改变。克山病是一种以心肌变性坏死为主要病理改变的生物地球化学性疾病。潜在型克山病是克山病的一种临床表现，可分为两型：1.稳定潜在型：起病即为潜在型克山病，符合潜在型诊断条件，其预后良好，很少转变为慢型、亚急型或急型；心电图以完全性右束支传导阻滞或室性期前收缩为主要表现（D对）；2.不稳定潜在型：此型多由急型或慢型克山病转变而来，经治疗后心脏功能恢复正常；心电图改变以T波（A错）、S-T段异常（BE错）或伴有Q-T间期延长（C错）为主要表现。